控制支气管哮喘气道慢性炎症最有效的
A. 糖皮质激素
B. β₂受体激动剂
C. 白三烯调节剂
D. M受体拮抗剂
E. H受体拮抗剂

正确答案：A。糖皮质激素

解析：糖皮质激素（A对）由于其局部抗炎作用强、全身不良反应少，已成为控制支气管哮喘气道慢性炎症最有效的药物。β₂受体激动剂分（B错）为短效吸入型抗胆碱能药物 （SAMA）（非控制性药物，为缓解性药物）和长效β₂受体激动剂 （LABA不单独使用）。白三烯调节剂（C错）是目前除 ICS 外唯一可单独应用的哮喘控制性药物，不是控制支气管哮喘气道慢性炎症最有效的药物。M受体拮抗剂（D错）虽能解痉止喘，但可产生一系列严重副作用，使其应用受限。H₂受体拮抗剂（E错）主要用于抗组胺引起的胃酸分泌。